生产放射性药品的药品生产企业的GMP认证工作由
A. 国务院质量技术监督管理部门负责
B. 国务院卫生行政部门负责
C. 国务院药品监督管理部门负责
D. 省级人民政府药品监督管理部门负责
E. 省级人民政府卫生行政部门负责

正确答案：C。国务院药品监督管理部门负责

解析：本题考查药品生产企业管理。生产放射性药品的药品生产企业的GMP认证工作由国务院药品监督管理部门负责（C对）。《中华人民共和国药品管理法实施条例》第五条：省级以上人民政府药品监督管理部门应当按照《药品生产质量管理规范》和国务院药品监督管理部门规定的实施办法和实施步骤，组织对药品生产企业的认证工作；符合《药品生产质量管理规范》的，发给认证证书。其中，生产注射剂、放射性药品和国务院药品监督管理部门规定的生物制品的药品生产企业的认证工作，由国务院药品监督管理部门负责。《药品生产质量管理规范》认证证书的格式由国务院药品监督管理部门统一规定。